过去经验过的事物再度出现时仍能认识，称为
A. 回忆
B. 再认
C. 追忆
D. 识记
E. 保持

正确答案：B。再认